患者行胃大部分切除术，需要输血1200ml，经主治医生填写申请单后由上级医师签字确认上交血液科，但输血科拒绝配血，理由为不符合程序，以上行为违反下列哪项程序
A. 科主任未签字
B. 医院领导未签字
C. 库存中心领导未签字
D. 医务科主任未签字
E. 全部医师签字

正确答案：A。科主任未签字

解析：患者行胃大部分切除术，需要输血1200ml（达到800毫升至1600毫升的的范围），经主治医生填写申请单后由上级医师签字确认上交输血科，但血液科拒绝配血，理由为不符合程序，以上行为违反了科主任未签字（A对）这项程序。